锥体交叉位于
A. 内囊
B. 大脑脚
C. 脑桥基底部
D. 延髓锥体
E. 延髓锥体下端

正确答案：E。延髓锥体下端

解析：锥体交叉位于延髓锥体下端（E对），是由皮质脊髓束纤维左右交叉形成的。